某患儿，7岁，行为刻板重复，智力低下，与他人存在交流障碍，但无认知-语言发有障碍。该患儿最可能患有下列哪种疾病
A. 雷特综合征
B. 儿童孤独症
C. 心境障碍
D. 注意缺陷多动症
E. 阿斯伯格综合征

正确答案：E。阿斯伯格综合征